十二经脉气血循环的起始经脉是
A. 手太阴肺经
B. 手厥阴心包经
C. 手少阴心经
D. 足太阴脾经
E. 足厥阴肝经

正确答案：A。手太阴肺经

解析：十二经脉的气血流注顺序为1.手太阴肺经（A对）—2.手阳明大肠经—3.足阳明胃经—4.足太阴脾经（D错）—5.手少阴心经（C错）—6.手太阳小肠经—7.足太阳膀胱经—8.足少阴肾经—9.手厥阴心包经（B错）—10.手少阳三焦经—11.足少阳胆经—12.足厥阴肝经（E错），至肝经而终，再由肝经复传于肺经，流注不已，从而构成了周而复始、如环无端的循环传注系统。